颅脑对冲伤最常见的部位是
A. 枕叶
B. 额颞叶
C. 小脑
D. 顶叶
E. 脑干

正确答案：B。额颞叶

解析：颅脑对冲伤是指头部遭受外力时，发生在着力部位对侧的脑损伤。由于枕骨内面和小脑幕表面比较平滑，而颅前窝和颅中窝底凹凸不平，因此，在对冲伤中，脑损伤最常见于额、颞叶前部和底部（B对）。